女，60岁。阴道脱出物3个月。査体：屏气用力时宫颈及部分宫体脱出阴道口外，宫颈前唇有一溃疡。首选的治疗是
A. 曼氏手术
B. 经阴道子宫全切术
C. 阴道纵隔形成术
D. 子宫托
E. 腹腔镜圆韧带缩短术

正确答案：B。经阴道子宫全切术

解析：该患者60岁，阴道脱出物3个月，屏气用力时宫颈及部分宫体脱出阴道口外（Ⅱ度重型：宫颈及部分宫体脱出阴道口），故诊断为Ⅱ度重型子宫脱垂。患者年龄较大及宫颈前唇有病变，首选的治疗是经阴道子宫全切术（B对）。曼氏手术（P289）（A错）其包括阴道前后壁修补、主韧带缩短及宫颈部分切除术，适用于年龄较轻、宫颈延长的子宫脱垂患者。阴道纵隔形成术（C错）仅适合于年老体弱不能接受较大手术，且无需保留性交功能者。子宫托（P289）（D错）适用于全身状况不适宜手术、妊娠期、产后和手术前有膨出面溃疡的患者。腹腔镜圆韧带缩短术（E错）适用于已完成生育要求，但需要保留子宫、最大程度保留性功能的年轻子宫脱垂患者。